急性坏死性溃疡性龈炎的临床特征
A. 牙龈红肿、牙松动、牙周流脓
B. 牙龈乳头呈刀削状缺损，疼痛出血，腐败性口臭
C. 牙龈黏膜广泛小疱
D. 牙龈黏膜出现乳白、微凸小点或斑块
E. 牙龈黏膜白色丘疹连成线条或网状

正确答案：B。牙龈乳头呈刀削状缺损，疼痛出血，腐败性口臭

解析：本题考查急性坏死性溃疡性龈炎的临床特征。急性坏死性溃疡性龈炎好发于青壮年，以男性吸烟者多见。起病急，病程较短。以龈乳头和龈缘坏死为其特征性损害，龈乳头被破坏后与龈缘成一直线，如刀切状。患处牙龈极易出血。疼痛明显。有典型的腐败性口臭（B对），可伴有全身症状。牙龈红肿、牙松动、牙周流脓（A错）为牙周脓肿的临床特征。牙龈黏膜广泛小疱（C错）多见于单纯疱疹病毒感染。牙龈黏膜出现乳白、微凸小点或斑块（D错）多考虑为口腔白斑病。牙龈黏膜白色丘疹连成线条或网状（E错）多考虑为口腔扁平苔藓。